急性心肌梗死与心绞痛的主要鉴别点是
A. 疼痛的部位
B. 疼痛的性质
C. 是否伴有多源性期前收缩
D. 是否伴有ST段抬高
E. 肌酸磷激酶同工酶升高

正确答案：E。肌酸磷激酶同工酶升高

解析：急性心肌梗死应首先与心绞痛鉴别，一般情况下前者症状更重，持续时间长，含服硝酸甘油不能缓解，心电图有动态演变，心肌损伤标志物升高，而心绞痛患者心肌损伤标志物不高（部分不稳定心绞痛患者可有cTn轻度升高，但未达到心肌梗死的诊断标准）。掌握“冠状动脉粥样硬化性心脏病”知识点。